正虚瘀结型积证治疗应用
A. 八珍汤
B. 化积丸
C. 八珍汤合化积丸
D. 膈下逐瘀汤
E. 膈下逐瘀汤合八珍汤

正确答案：C。八珍汤合化积丸

解析：正虚瘀结当以八珍汤补虚固本，化积丸化瘀消积以治标（C对AB错）。膈下逐瘀汤主要应用于瘀在膈下，具有活血逐瘀，破症消结之功效。主治积聚痞块，痛不移处，卧则腹坠，及肾泻、久泻由瘀血所致者，对于淤血疗效甚佳，但消积作用不强故不做积证首选方（DE错）